女性膀胱上方毗邻主要为
A. 小肠
B. 子宫
C. 卵巢
D. 直肠
E. 输尿管

正确答案：B。子宫

解析：如图所示，女性膀胱上方毗邻主要为子宫（B对）。